精神障碍患者的病例资料及保管说法有误的是
A. 医疗机构及其医务人员应当在病历资料中如实记录精神障碍患者的病情、治疗措施、用药情况、实施约束、隔离措施等内容
B. 医疗机构及其医务人员应当如实告知患者或者其监护人
C. 患者及其监护人可以查阅、复制病历资料
D. 患者查阅、复制可能对其治疗产生不利影响的不得查阅复制病历资料
E. 病历资料保存期限不得少于二十年

正确答案：E。病历资料保存期限不得少于二十年